乳牙多个牙牙冠破坏严重，充填治疗时应特别注意
A. 恢复接触点
B. 恢复牙尖嵌合关系
C. 恢复咬合高度
D. 防止颊、舌壁折裂
E. 以上均是

正确答案：C。恢复咬合高度

解析：本题考查乳牙龋修复治疗的注意事项和特点。在数个牙的牙冠崩坏时，应特别注意恢复咬合高度（C对），因为良好的咬合高度不仅对颌面部的正常生长发育及恒牙列的形成意义重大，而且还可以提高咀嚼效率，促进儿童全身发育。在修复外形时考虑到生理间隙的特点，因此不必勉强恢复接触点（A错）。尽可能恢复原来的外形但不拘泥于牙尖嵌合关系（B错）的修复。任何修复过程中都应注意防止颊、舌壁折断（D错）。